26岁女性，已婚。停经36天，平素月经规律。问以下最有可能出现的是
A. 黏液镜下可见羊齿状结晶
B. 尿妊娠试验阳性
C. 双合诊可见黑加征
D. 子宫增大为非孕时的3倍
E. 出现严重的早孕反应

正确答案：B。尿妊娠试验阳性

解析：该患者女，26岁，已婚。停经36天，平素月经规律。结合患者的病史和表现，最有可能出现的是尿妊娠试验阳性（B对）。宫颈黏液结晶检查：根据羊齿植物叶状结晶的出现与否判断有无排卵，月经前仍可见羊齿状结晶表示无排卵（A错）。阴道黏膜和宫颈阴道部充血呈紫蓝色。妊娠6～8周时，双合诊检查子宫峡部极软，感觉宫颈与宫体之间似不相连，称为黑加征。子宫逐渐增大变软，呈球形。妊娠8周 时，子宫为非孕时的2倍，妊娠12 周时为非孕时的3倍，宫底超出盆腔，可在耻骨联合上方触及（CD错）。早孕反应 在停经6周左右出现畏寒、头晕、流涎、乏力、嗜睡、 食欲缺乏、喜食酸物、厌恶油腻、恶心 、晨起呕吐等症状，称为早孕反应，部分患者有情绪改变。多在停经12周左右自行消失（E错）。